对牙周病破坏最大的不良生活习惯是
A. 酗酒
B. 吸烟
C. 不正确的剔牙
D. 口呼吸
E. 咬硬物

正确答案：B。吸烟

解析：研究已证实，吸烟是牙周病尤其是重度牙周炎的高危因素。吸烟与维护期中牙周炎的复发有关，为依赖性。重度吸烟者（＞10支/天）疾病进展较快，戒烟者较现吸烟者复发的危险性低。牙槽骨的吸收程度与吸烟量有关。由于吸烟增加了附着丧失和骨丧失的危险性，使牙周组织的破坏加重，因而吸烟状况可作为评估个体牙周炎危险因素的一个重要指标。掌握“牙周疾病促进因素”知识点。